同时服用，有利于铁吸收的药物是
A. 维生素A
B. 维生素B
C. 维生素C
D. 维生素D
E. 维生素E

正确答案：C。维生素C

解析：本题考查药物的相互作用。维生素C（C对）能够促进去铁胺对铁的螯合，使铁的排出加速。维生素A（A错）是骨骼生长和胚胎发育所需要的。维生素B（B错）用于治疗和预防维生素B族缺乏所致的营养不良、厌食、脚气病、糙皮病等。维生素D（D错）能促进小肠对钙的吸收，维持血浆钙、磷正常浓度。维生素E（E错）能够促进性激素分泌。